rRNA约占细胞总RNA的
A. 40%以上
B. 50%以上
C. 60%以上
D. 70%以上
E. 80%以上

正确答案：E。80%以上

解析：核糖体RNA（rRNA）是细胞内含量最丰富的RNA，约占细胞总RNA的80%以上。它们与核糖体蛋白共同构成核糖体，后者是蛋白质合成的场所。掌握“RNA”知识点。